心房颤动引起的常见卒中类型是
A. 分水岭脑梗死
B. 短暂性脑缺血发作
C. 脑栓塞
D. 脑血栓形成
E. 腔隙性脑梗死

正确答案：C。脑栓塞

解析：心房颤动时左心房收缩性降低，血流缓慢游滞，易导致附壁血栓，栓子脱落易引起脑栓塞（C对）。分水岭脑梗死（P179）（A错）、短暂性脑缺血发作（TIA）（P172）（B错）、腔隙性脑梗死（P186）（E错）均可由心房颤动附壁血栓脱落所致，但发生率不如脑栓塞高。脑血栓形成（D错）是因为局部血管本身存在病变而继发血栓形成所致，动脉粥样硬化是本病的根本病因。